下列能导致水体富营养化的元素是
A. N、P
B. Ca、Mg
C. Zn、P
D. Cu、N
E. Ca、P

正确答案：A。N、P

解析：水体富营养化指的是水体中N、P等营养盐含量过多而引起的水质污染现象（A对）。